老年人服用糖皮质激素，可能导致骨质疏松症以外的不良反应是
A. 婴儿生长发育抑制
B. 血压升高
C. 胎盘功能不全
D. 支气管哮喘
E. 儿童生长发育抑制

正确答案：B。血压升高

解析：本题考查糖皮质激素的使用。老年人服用糖皮质激素，可能导致骨质疏松症以外的不良反应是血压升高（B对）。老年人长期使用糖皮质激素需要预防消化道溃疡、感染、骨质疏松症和高血压等；有精神病史的患者避免使用。婴儿生长发育抑制（A错）是哺乳期妇女使用糖皮质激素的不良反应。胎盘功能不全（C错）是妊娠妇女使用糖皮质激素的不良反应。支气管哮喘（D错）是糖皮质激素的适应证。儿童生长发育抑制（E错）是儿童使用糖皮质激素的不良反应。